味甘性平，主治血吸虫病的中药是
A. 鹤草芽
B. 南瓜子
C. 苦楝皮
D. 使君子
E. 贯众

正确答案：B。南瓜子

解析：本题考查南瓜子的性能特点。味甘性平，主治血吸虫病的中药是南瓜子（B对）。南瓜子【性能特点】本品甘香油润，平而不偏，入胃经与大肠经。既驱杀绦虫、蛔虫、钩虫、血吸虫，又润肠通便而利于虫体排出。尤为治绦虫病之良药，常与槟榔合用。鹤草芽（A错）【性能特点】本品苦泄降，凉能清，涩兼敛，入肝、小肠、大肠经。既善杀绦虫，又兼泻下而利于虫体排出，为治绦虫病之要药。苦楝皮（C错）【性能特点】本品苦燥寒清，有毒而力较强，入脾、胃、肝经。内服善毒杀蛔虫、蛲虫、钩虫，治蛔虫病、蛲虫病、钩虫病。外用能除湿热、杀灭皮肤寄生虫及抑制致病真菌，治头癣、疥疮。使君子（D错）【性能特点】本品甘温气香，入脾、胃经。善杀虫、消积，既为治蛔虫病、蛲虫病之佳品，又为治小儿疳积之要药。贯众（E错）【性能特点】本品苦微寒清泄，有小毒，力较强，入肝、胃经。生用苦寒清泄，既杀虫，又清热解毒，治多种肠道寄生虫病、风热感冒及温毒发斑。炒炭则兼涩味，清泄与收敛并举，能凉血收敛而止血，治血热出血。